毛细血管是全身分布广泛，功能强大的血管系统，在血液与周围组织间进行物质交换的过程中发挥着重要作用。哪些不是连续毛细血管的特征
A. 由连续的内皮细胞围成
B. 基膜完整
C. 胞浆中有许多吞饮小泡
D. 主要分布于肌组织和中枢神经系统等处
E. 内皮细胞上有许多贯穿细胞的孔，且孔有隔膜封闭

正确答案：E。内皮细胞上有许多贯穿细胞的孔，且孔有隔膜封闭

解析：连续毛细血管内皮细胞无窗孔（E错，为本题正确答案），内皮细胞之间有紧密连接封闭。